治疗肺癌痰湿毒蕴证，应首选
A. 导痰汤
B. 温胆汤
C. 六君子汤
D. 七味白术散
E. 补中益气汤

正确答案：A。导痰汤

解析：肺癌痰湿毒蕴证治宜祛湿化痰，首选燥湿豁痰，行气开郁的导痰汤（A对）。温胆汤理气化痰，和胃利胆，主治胆郁痰扰证（B错）。六君子汤益气健脾，燥湿化痰，主治脾胃气虚，兼痰湿证（C错）。七味白术散功用健脾益气，和胃生津，适用于脾胃虚弱，津虚内热证（D错）。补中益气汤功用补中益气，升阳举陷主治脾胃气虚证、气虚下陷证、气虚发热证（E错）。